患儿泄泻清稀，中多泡沫，臭气不甚，腹痛肠鸣，其证候是
A. 风寒泻
B. 伤食泻
C. 脾虚泻
D. 湿热泻
E. 脾肾阳虚泻

正确答案：A。风寒泻

解析：泄泻是以大便次数增多，粪质稀薄或如水样为特征的一种小儿常见病，寒邪客于肠胃，寒凝气滞，中阳被困，运化失职，故见泄泻清稀，粪多泡沫，臭气不甚。风寒郁阻，气机不得宣通，故见肠鸣腹痛（A对）。伤食泻特征为起病前有乳食不节史，便稀夹不消化物，气味酸臭，脘腹胀痛，泻后痛减（B错）。脾虚泻可见大便稀溏，多于食后作泻，以及全身脾虚征象（C错）。湿热泻以起病急，泻下急迫，量多次频，舌质红，苔黄腻为特征（D错）。脾肾阳虚泻本证见于久泻，以大便澄澈清冷，完谷不化，形寒肢冷为特征（E错）。